在进行宫颈癌病因的病例对照研究时，下列哪一组病例最为理想
A. 一所肿瘤专科医院收治的所有宫颈癌患者
B. 一个地区多所医院诊断的所有宫颈癌患者
C. 一个地区肿商发病监测系统登记的所有宫颈癌患者
D. 一个地区肿瘤死亡监测系统登记的所有宫颈癌患者
E. 一个地区多所医院新诊断的宫颈癌患者

正确答案：C。一个地区肿商发病监测系统登记的所有宫颈癌患者